表面灰黄色或黄褐色，有不规则结节状隆起，有的节间表面平滑如茎秆，习称“过桥”的药材是
A. 黄连
B. 桔梗
C. 羌活
D. 玉竹
E. 巴戟天

正确答案：A。黄连

解析：本题考查的是黄连的性状鉴别。表面灰黄色或黄褐色，有不规则结节状隆起有的节间表面平滑如茎秆，习称“过桥”的药材是黄连（A对）。黄连：【性状鉴别】药材味连多分枝，常弯曲，集聚成簇，形如鸡爪。表面灰黄色或黄褐色，粗糙，有不规则结节状隆起、须根及须根残基，有的节间表面平滑如茎秆，习称“过桥”。上部多残留褐色鳞叶，顶端常留有残余的茎或叶柄。质硬，断面不整齐，皮部橙红色或暗棕色，木部鲜黄色或橙黄色，呈放射状排列，髓部有的中空。气微，味极苦。桔梗（B错）：【性状鉴别】药材呈圆柱形或略呈纺锤形，下部渐细，有的有分支，略扭曲。表面淡黄色至黄色，不去外皮的表面黄棕色至灰棕色，具纵扭皱沟，并有横长的皮孔样斑痕及支根痕，上部有横纹。有的顶端有较短的根茎或不明显，其上有数个半月形茎痕。质脆，断面不平坦，横切面可见放射状裂隙，皮部黄白色，形成层环棕色，木部淡黄色。气微，味微甜后苦。羌活（C错）：【性状鉴别】药材根茎圆柱形，略弯曲。顶端具茎痕。表面棕褐色至黑褐色，外皮脱落处呈黄色。节间缩短，呈紧密隆起的环状，形似蚕，习称“蚕羌”；节间延长，形如竹节状，习称“竹节羌”。节上有多数点状或瘤状突起的根痕及棕色破碎鳞片。体轻，质脆，易折断，断面不平整，有多数裂隙，皮部黄棕色至暗棕色，油润，有棕色油点，木部黄白色，射线明显，髓部黄色至黄棕色。气香，味微苦而辛。玉竹（D错）：【性状鉴别】药材呈长圆柱形，略扁，少有分枝。表面黄白色或淡黄棕色，半透明，具纵皱纹和微隆起的环节，有白色圆点状须根痕和圆盘状茎痕。质硬而脆或稍软，易折断，断面角质样或显颗粒性。气微，味甘，嚼之发黏。巴戟天（E错）：【性状鉴别】药材为扁圆柱形，略弯曲，长短不等。表面灰黄色或暗灰色，具纵纹及横裂纹，有的皮部横向断离露出木部，形似连珠。质坚韧，断面皮部厚，紫色或淡紫色，易与木部剥离；木部坚硬，黄棕色或黄白色。气微，味甘而微涩。